五味中入肝经的是
A. 苦
B. 甘
C. 酸
D. 辛
E. 咸

正确答案：C。酸

解析：所谓五味，是指药物有酸咸不同的药味，因而具有不同的治疗作用，《黄帝内经》将五味与五脏联系了起来，指出酸入肝（C对）、辛入肺、苦入心、咸入肾、甘入脾，但这只是一般规律的总结，并不是一成不变的，更重要的还是根据长期的临床实践总结五味理论。